某中年妇女近期出现疲乏，厌食、便秘、失眠和烦躁等症状，病史发现该妇女长期大量食用精米、白面，怀疑是某种维生素缺乏，为确诊应进一步检查的项目是
A. 血浆维生素A测定
B. 红细胞溶血试验
C. 红细胞谷胱甘肽还原酶活性系数
D. 红细胞转酮醇酶活力系数
E. 血浆同型半胱氨酸含量

正确答案：D。红细胞转酮醇酶活力系数